下列哪一种情况，必须作牙体缺损的修复
A. 左下6近中舌尖缺损，已作根管治疗，无症状
B. 左上4舌尖缺损少许，无过敏症状
C. 左上2唇面釉质缺损少许，无症状
D. 左上2远中切角缺损有叩痛，松动Ⅲ度
E. 左下7近中及远中颊尖缺损，已侵及髓室

正确答案：A。左下6近中舌尖缺损，已作根管治疗，无症状

解析：本题考查牙体缺损的修复。牙体缺损是口腔的常见病和多发病，一般情况下可以采用充填的方法进行治疗。当牙体缺损严重，充填不易成功或需要达到更高的美观要求时，则应采用修复治疗的方法。已作根管治疗的牙（A对），失去了牙髓，也就失去了持续营养源，且牙齿脆性增加、抗弯性降低，硬度降低，易发生牙体损坏；为保护余留的牙体组织，必须做修复体保护。当左上4舌尖缺损少许，无过敏症状（B错）及左上2唇面釉质缺损少许，无症状（C错）时，无需处理，注意保护即可。当左上2远中切角缺损有叩痛，松动Ⅲ度时（D错），牙应拔除。当左下7近中及远中颊尖缺损，已侵及髓室（E错）时，视牙髓状况，行间接盖髓术或根管治疗术，最后充填。